由空气传播的致病微生物有
A. 丁肝病毒
B. 丙肝病毒
C. 乙肝病毒
D. 腺病毒
E. 人体免疫缺陷病毒

正确答案：D。腺病毒

解析：本题考查由空气传播的致病微生物。由空气传播的致病微生物有腺病毒（D对）。经接触传播的微生物：乙肝病毒（C错）、丙肝病毒（B错）、丁肝病毒（A错）、单纯疱疹病毒Ⅰ型、单纯疱疹病毒Ⅱ型、人类免疫缺陷病毒（E错）、淋病双球菌、梅毒螺旋体、铜绿假单胞菌、金色/白色葡萄球菌、破伤风杆菌。经空气传播的主要微生物：水痘病毒、麻疹病毒、风疹病毒、流行性腮腺炎病毒、流感病毒、结核杆菌、化脓性链球菌。